炎性充血主要是指
A. 动脉扩张，局部组织含血量增多
B. 静脉回流障碍，组织含血量增多
C. 炎区微循环内血量增多
D. 炎区小血管破裂
E. 炎区组织间隙中血量增多

正确答案：A。动脉扩张，局部组织含血量增多

解析：炎性充血主要是指在炎症反应的早期，致炎因子和血管活性胺类的作用使动脉扩张，局部组织含血量增多（A对）。静脉回流障碍，组织含血量增多（B错）是淤血（又称静脉性充血）的表现。